成瘾性最小的镇痛药是
A. 吗啡
B. 芬太尼
C. 哌替啶
D. 喷他佐辛
E. 美沙酮

正确答案：D。喷他佐辛

解析：喷他佐辛（D对）主要激动K阿片受体发挥镇痛作用，对μ型阿片受体有弱的拮抗作用，无明显欣快感和成瘾性，但不能拮抗吗啡的呼吸抑制作用，并能促进吗啡成瘾者出现戒断症状，临床主要用于轻、中度疼痛的短期止痛。吗啡（A错）对各种原因引起的疼痛均有强大的镇痛作用，但易成瘾，一般用于对其他镇痛药无效的疼痛，如骨折、严重创伤、烧伤以及晚期恶性肿瘤疼痛等。芬太尼（B错）的化学结构与哌替啶相似，主要激动μ型阿片受体，效价强度为吗啡的80倍，可产生明显欣快、呼吸抑制和成瘾性。哌替啶（C错）为人工合成的μ受体激动剂，为目前临床上应用最广泛的人工合成镇痛药，长期反复应用也易引起耐受性和成瘾性。美沙酮（E错）为μ型阿片受体激动剂，镇痛作用与吗啡相当，镇静、抑制呼吸等作用弱于吗啡，耐受性和成瘾性发生较慢，戒断症状略轻。